女性，50岁黄疸病人，B超检查显示肝内胆管直径约1cm，应进一步选择的检查是
A. 静脉胆道造影
B. 核素扫描
C. 经皮肝穿刺胆道造影
D. 十二指肠低张造影
E. 腹腔动脉造影

正确答案：C。经皮肝穿刺胆道造影

解析：黄疸病人，肝内胆管直径约1cm（肝内胆管扩张），进一步检查需确定黄疸病因，应选择经皮肝穿刺胆道造影（C对）。经皮肝穿刺胆管造影可显示肝内外胆管病变部位、范围、程度和性质，特别有助于黄疸的诊断以及鉴别诊断。静脉胆道造影（A错）受肝功能状态的影响，胆道显影率低，主要用于复查口服法胆囊不显影者，或胆囊切除术后仍然有症状的病人。核素扫描（B错）主要用于检查急性胆囊炎时的胆囊管梗阻以及术后的胆肠吻合口狭窄或胆汁漏。十二指肠低张造影（D错）属于逆行造影，对肝内胆管显像较经皮肝穿刺胆道造影差。腹腔动脉造影（E错）中的选择性肝动脉造影或门静脉造影多用于判断上段胆管癌能否手术切除，或用于胆道出血的诊断和治疗。